胃癌好发部位是
A. 幽门管
B. 胃底和胃体
C. 胃体大弯侧
D. 胃窦小弯侧
E. 贲门小弯侧

正确答案：D。胃窦小弯侧

解析：胃癌的好发部位是胃窦小弯侧（D对）。胃癌的好发部位依次为胃窦（58%）、贲门（20%）、胃体（15%）、全胃或大部分胃（7%）。